对青霉素和头孢菌素过敏者，围手术期针对革兰阴性球菌感染和预防用药，宜选用
A. 氟罗沙星
B. 妥布霉素
C. 氨曲南
D. 克林霉素
E. 多黏菌素

正确答案：C。氨曲南

解析：本题考查围术期抗生素的选用。对青霉素和头孢菌素过敏者，针对革兰阳性球菌可选氨曲南（C对）。